有关齿状线解剖意义的描述中，错误的是
A. 齿状线以上是粘膜，以下是皮肤
B. 齿状线以上发生的痔是内痔，以下的痔是外痔
C. 齿状线以上由直肠上下动脉供血，以下由肛管动脉供应
D. 齿状线以上淋巴引流入髂外淋巴结，以下入腹股沟淋巴结
E. 齿状线以上受植物神经支配，以下属阴部内神经支配

正确答案：D。齿状线以上淋巴引流入髂外淋巴结，以下入腹股沟淋巴结

解析：齿状线是直肠与肛管的交界线。齿状线以上淋巴引流入腹主动脉旁淋巴结、髂内淋巴结，齿状线以下淋巴引流入腹股沟淋巴结、髂外淋巴结（D错，为本题正确答案）。齿状线以上的供应动脉主要来自直肠上动脉，其次为来自髂内动脉的直肠下动脉和骶正中动脉。齿状线以下的血液供应为肛管动脉（C对）。以齿状线为界，齿状线以上由交感神经和副交感神经支配。齿状线以下的肛管及其周围结构主要由阴部神经的分支支配（E对）。内痔是肛垫的支持结构、静脉丛及动静脉吻合支的病理性改变或移位，发生于齿状线上，外痔是齿状线远侧皮下静脉丛的病理性扩张或血栓形成（B对）。齿状线以上是粘膜，受植物神经支配；齿状线以下是皮肤，受阴部内神经支配（AE对）。